久用可致高铁血红蛋白血症的药物是
A. 氯喹
B. 奎宁
C. 伯氨喹
D. 乙胺嘧啶
E. 青蒿素

正确答案：C。伯氨喹

解析：本题考查伯氨喹的不良反应。久用可致高铁血红蛋白血症的药物是伯氨喹（C对）。伯氨喹毒性反应较其他抗疟药更高，易疲倦、头晕、恶心，久用可致高铁血红蛋白血症。氯喹（A错）不良反应有头晕、腹泻等。奎宁（B错）不良反应有金鸡纳反应等。乙胺嘧啶（D错）的不良反应有叶酸缺乏等。青蒿素（E错）的不良反应有呕吐、厌食等。